属病因诊断的是
A. 二尖瓣狭窄
B. 风湿性心脏病
C. 心房颤动
D. 心慌气短
E. 下肢浮肿

正确答案：B。风湿性心脏病

解析：病因诊断指明确致病原因，体现疾病的性质，反映疾病的发展、转归和预后，对疾病的治疗和预防起决定性的作用。属病因诊断的是风湿性心脏病（B对）。病理形态诊断指对疾病的病变部位、范围、性质以及组织结构的改变作出的诊断。属病理解剖的诊断是二尖瓣狭窄（A错）。心房颤动属于病理生理诊断（C错）。心慌气短、下肢浮肿属于症状（DE错）。